患者因受精神刺激而气逆喘息，面红口赤，呕血，昏厥卒倒其病机是
A. 怒则气上
B. 悲则气消
C. 喜则气缓
D. 思则气结
E. 恐则气下

正确答案：A。怒则气上

解析：怒则气上指过怒导致肝气疏泄太过，气机上逆，甚则血随气逆、并走于上的病机变化，其临床主要表现为头胀头痛，面红目赤，甚则呕血、昏厥卒倒等（A对）；悲则气消指过度悲忧伤肺，导致肺气耗伤、肺失宣降的病机变化，其临床常见精神不振，意志消沉，胸闷气短，懒言乏力等症（B错）；喜则气缓指过度喜乐伤心，导致心气涣散不收，重者心气暴脱、神不守舍的病机变化，其临床可见精神不集中，神志失常，狂乱，或见心气暴脱的大汗淋漓，气息微弱，脉微欲绝等症（C错）；思则气结指过度思虑伤脾，导致脾气结滞、运化失职的病机变化，临床可见精神萎靡，反应迟钝，不死饮食，腹胀纳呆，便溏等症（D错）；恐则气下指过度恐惧伤肾，导致肾气不固、气陷于下的病机变化，临床可见大恐引起的二便失禁，甚则遗精等症（E错）。